头面部浅感觉传导通路
A. 第1级神经元胞体在三叉神经节内
B. 二级纤维在脊髓交叉
C. 二级纤维投射到中央后回和中央旁小叶后部
D. 三级纤维经过内囊膝部
E. 无

正确答案：A。第1级神经元胞体在三叉神经节内

解析：头面部浅感觉传导通路第1级神经元为三叉神经节内（A对）的假单极神经元。第2级神经元在脑干的三叉神经脊束核和三叉神经脑桥核内，上述二核发出纤维交叉到对侧（B错），组成三叉丘脑束，止于背侧丘脑的腹后内侧核（C错）。第3级神经元的胞体在背侧丘脑的腹后内侧核，发出纤维经过内囊后肢（D错），投射到中央后回下部。